二氧化硅在牙膏中是
A. 胶黏剂
B. 润湿剂
C. 防腐剂
D. 摩擦剂
E. 洁净剂

正确答案：D。摩擦剂

解析：本题考查牙膏的成分。二氧化硅在牙膏中是摩擦剂（D对）。牙膏中的摩擦剂包括碳酸钙、磷酸钙、不溶性偏磷酸钠、焦磷酸钙、二氧化硅等；胶黏剂包括羧甲基纤维素、钠或镁铝硅酸盐复合体（A错）；润湿剂包括甘泊、山梨醇、丙二醇（B错）；防腐剂包括异氢氧安息香、对羟基苯甲酸酯类、三氯羟苯醚（C错）；洁净剂包括十二醇硫酸钠、脂肪硫醋钠月桂醇硫酸酯钠盐、月桂酰肌氨酸钠、蔗糖脂肪酸酯（E错）。